下列有关腭裂描述正确的是
A. 很少会伴发唇裂
B. 侧腭突和鼻中隔未融合
C. 仅发生于双侧
D. 侧腭突和上颌突部分融合
E. 以上说法均正确

正确答案：B。侧腭突和鼻中隔未融合

解析：腭裂：是口腔较常见的一种畸形，为侧腭突和鼻中隔未融合或部分融合的结果。腭裂可发生于单侧，也可发生于双侧。约80%的腭裂患者伴有单侧或双侧唇裂。掌握“腭部与舌的发育”知识点。